大气污染物二氧化碳对环境的主要影响是
A. 臭氧层破坏
B. 形成酸雨
C. 产生温室效应
D. 产生光化学烟雾
E. 使大气混浊度增加，造成到达地面的太阳辐射大为减少

正确答案：C。产生温室效应

解析：本题考查大气污染物对环境的主要影响。大气污染物二氧化碳能吸收地表发射的热辐射，使大气增温，产生温室效应（C对ABDE错）。